贿赂行为规定
A. 经营者销售，明示方式给对方回扣
B. 经营者销售，给对方回扣，如实入账
C. 经营者销售，给中间人报酬，未如实入账
D. 经营者销售，销售让利
E. 赠送小额广告礼品

正确答案：A、B、D、E。经营者销售，明示方式给对方回扣；经营者销售，给对方回扣，如实入账；经营者销售，销售让利；赠送小额广告礼品

解析：本题考查商业贿赂行为。经营者在交易活动中，可以以明示方式向交易相对方支付折扣（A对），或者向中间人支付佣金。经营者向交易相对方支付折扣、向中间人支付佣金的，应当如实入账（B对）。接受折扣、佣金的经营者也应当如实入账（DE对）。